适应性免疫应答分为几个阶段
A. 2
B. 3
C. 4
D. 5
E. 6

正确答案：B。3